关于腭大孔的叙述，哪项是不正确的
A. 距硬腭后缘约0.5cm处
B. 有腭前神经和血管通过
C. 位于上颌第三磨牙腭侧牙槽嵴顶至腭正中缝连线的中点
D. 由上颌骨牙槽突与腭骨水平部共同构成
E. 是翼腭管的下口

正确答案：C。位于上颌第三磨牙腭侧牙槽嵴顶至腭正中缝连线的中点

解析：本题考查上颌骨解剖特点。牙槽突（牙槽骨）两侧上颌牙槽突在中线相接，形成牙槽骨弓，上颌牙槽突与腭骨水平部共同构成腭大孔，有腭前神经通过，腭大孔的表面标志位于上颌第三磨牙腭侧牙龈缘至腭中缝连线的中外1/3的交点上，距硬腭后缘约0.5cm处；或位于上颌第三磨牙腭侧龈缘至腭中线弓形连线的中点（C错，为本题正确答案）。